关于需要、需求、利用下列叙述正确的是
A. 卫生服务需要都能转化成卫生服务需求
B. 卫生服务利用不能直接用于评价卫生服务的效果
C. 卫生服务利用主要取决于卫生服务需求
D. 卫生服务需要主要反映了居民对健康的一种主观愿望

正确答案：B。卫生服务利用不能直接用于评价卫生服务的效果

解析：本题考查卫生服务需要、需求、利用。卫生服务利用指需求者实际利用卫生服务的数量（即有效需求量），是人群卫生服务需要量和卫生资源供给量相互制约的结果（C错），直接反映了卫生系统为居民健康提供卫生服务的数量和工作效率，间接反映了卫生系统通过卫生服务对居民健康状况的影响，但不能直接用于评价卫生服务的效果（B对）。人们的卫生服务需要只有转化为需求，才有可能去利用医疗卫生服务。但在现实生活中，并不是人们所有的卫生服务需要都能转化为需求（A错）。需要能否转化为需求，除了与居民本身是否觉察到卫生服务需要外，还与其收入水平、社会地位、健康保障、交通便利程度、风俗习惯健康意识，以及卫生机构提供的服务类型和质量等多种因素有关。卫生服务要求主要反映了居民对健康的一种主观愿望（D错）。